牛黄醒消丸能清热解毒、活血祛瘀、消肿止痛，其主治有
A. 痈疽发背
B. 瘰疬流注
C. 乳痈乳岩
D. 水火烫伤
E. 无名肿毒

正确答案：A、B、C、E。痈疽发背；瘰疬流注；乳痈乳岩；无名肿毒

解析：本题考查的是牛黄醒消丸的主治。牛黄醒消丸能清热解毒、活血祛瘀、消肿止痛，其主治有痈疽发背（A对）、瘰疬流注（B对）、乳痈乳岩（C对）、无名肿毒（E对）。牛黄醒消丸：【主治】热毒郁滞、痰瘀互结所致的痈疽发背、瘰疬流注、乳痈乳岩、无名肿毒。